某患者患下颌骨恶性肿物，进行性张口困难，下唇麻木，出现这些症状的可能原因为
A. 颊长神经及颞下颌关节受累
B. 下颌缘支及升颌肌群受累
C. 下牙槽神经及升颌肌群受累
D. 颊长神经及升颌肌群受累
E. 下颌缘支及颞下颌关节受累

正确答案：C。下牙槽神经及升颌肌群受累

解析：本题考查下牙槽神经损伤及张口受限的原因。咀嚼肌群或颞下颌关节受累可导致开口受限，恶性肿物位于下颌骨最可能使升颌肌群受累；肿瘤压迫下牙槽神经，可导致下唇麻木（C对）。颊长神经分布于下颌磨牙及第二前磨牙的颊侧牙龈及颊部的黏膜和皮肤（AD错）。下颌缘支损伤，可导致患侧口腔下垂及流涎（BE错）。